关于视神经盘的描述哪项错误？
A. 该处视神经纤维集中，故视力极敏感
B. 位于黄斑的内侧
C. 视网膜中央动脉、静脉经此出入
D. 位于眼球后极的内侧
E. 为节细胞轴突汇聚处

正确答案：A。该处视神经纤维集中，故视力极敏感

解析：视神经盘位于黄斑鼻侧，即位于黄斑内侧（B对），眼球后极的内侧（D对），视神经中央动脉、静脉经此出入（C对），且该处无感光细胞分布，是节细胞轴突汇聚处（E对），故视力极不敏锐（A错，为本题正确答案）。